乳牙早失引起间隙改变，下列各项中错误的是
A. 乳尖牙早失，间隙易变小
B. 年龄越小间隙改变越快
C. 乳切牙早失，间隙变化较小
D. 乳磨牙早失，若第一恒磨牙正在萌出，间隙易变小
E. 第一恒磨牙萌出前，第一乳磨牙早失，间隙很少改变

正确答案：E。第一恒磨牙萌出前，第一乳磨牙早失，间隙很少改变

解析：本题考查乳牙早失引起的间隙改变。第一恒磨牙萌出前，第一乳磨牙早失可能影响恒尖牙萌出，磨牙间隙很容易缩小或消失（E错，为本题的正确答案）。乳牙早失后，因邻牙移位，对颌牙伸长，使间隙的近远中径和垂直径变小。牙列越拥挤，牙齿在牙弓内的正确位置的保持失去平衡，间隙变小的可能性越大，乳牙早失时患儿年龄越小，间隙改变越快（B对）。由于恒切牙均比乳切牙大，在颌骨的发育过程中，前牙区牙槽骨增长显著，以容纳恒切牙，所以乳切牙早失，间隙变化较小（C对）。乳尖牙常受恒侧切牙萌出时的压迫吸收而早期脱落，因此乳尖牙早失，间隙易变小（A对）。乳磨牙早失，第一恒磨牙萌出时近中方向无阻力，磨牙间隙很容易变小（D对）。